血栓头部一般属于
A. 白色血栓
B. 红色血栓
C. 透明血栓
D. 混合血栓
E. 延续性血栓

正确答案：A。白色血栓

解析：延续性血栓是指静脉血栓在形成过程中不断沿血管延伸而增长（E错），延续性血栓的头部一般属于白色血栓（A对）。红色血栓（B错）一般为延续性血栓的尾部。混合血栓（D错）一般为延续性血栓的体部。透明血栓（C错）主要发生于毛细血管内，不属于延续性血栓。